以人年为单位计算的率为
A. 发病率
B. 发病密度
C. 病死率
D. 现患率
E. 死亡率

正确答案：B。发病密度

解析：本题考查以人年为单位计算的率。以观察人时为分母计算的发病率带有瞬时频率性质称为发病密度。发病密度（B对ACDE错）最常用的人时单位是人年，以此求出人年发病（死亡）率。